下列方法能够达到灭菌的效果的是
A. 重金属盐类消毒剂
B. 75%酒精消毒剂
C. 生石灰水消毒剂
D. 过氧乙酸消毒剂
E. 高压蒸汽灭菌法

正确答案：E。高压蒸汽灭菌法

解析：消毒与灭菌的方法一般分为物理学方法和化学方法两大类。物理学方法多可达到灭菌的效果，而化学方法多数仅达到消毒目的。高压蒸汽灭菌法为物理灭菌方法，故可以达到灭菌的效果。掌握“消毒与灭菌”知识点。